下列是制订大气卫生标准的主要方法，除了
A. 流行病学方法
B. 毒理学方法
C. 健康危险度评价法
D. 大气中有害物质的嗅觉阀和刺激阈测定
E. 环境监测

正确答案：E。环境监测

解析：本题考查制订大气卫生标准的主要方法。制订大气卫生标准的主要方法包括流行病学方法（A对）、毒理学方法（B对）、健康危险度评价法（C对）、大气中有害物质的嗅觉阈和刺激阈测定（D对）等。环境监测（E错，为本题正确答案）不是制订大气卫生标准的方法。